牙位是指
A. 牙尖交错位
B. 正中（牙合）位
C. 正中关系位
D. 下颌姿势位
E. 后退接触位

正确答案：A。牙尖交错位

解析：本题考查颌位。牙位是指牙尖交错位（A对）。牙尖交错位（ICP）是指上下颌牙牙尖交错，达到最广泛、最紧密接触时下颌所处的位置，即牙尖交错（牙合）时下颌骨相对于上颌骨或者颅底的位置关系。该位置因牙尖交错（牙合）而存在，故有人称为‘牙位’或者最大牙尖交错位（MIP）。鉴于正常情况下牙尖交错位时下颌骨的位置居于正中，过去曾称为正中（牙合）位（COP），但事实上并不是所有的人在牙尖交错位时其下颌位置都处于正中，因此牙尖交错位比正中颌位更能准确地描述该颌位的特征。